手太阴肺经与它经交接的部位是
A. 在无名指交于手少阳三焦经
B. 在小指端交于手太阳小肠经
C. 在足大趾交于足厥阴肝经
D. 在足大趾交于足太阴脾经
E. 在食指端交于手阳明大肠经

正确答案：E。在食指端交于手阳明大肠经

解析：手太阴肺经在食指端与手阳明大肠经相交接（E对）；手厥阴心包经在无名指端与手少阳三焦经相交接（A错）；手少阴心经在小指端与手太阳小肠经交接（B错）；足少阳胆经在足大趾爪甲后丛毛处与足厥阴肝经相交接（C错）；足阳明胃经在足大趾与足太阴脾经相交接（D错）；